急性苯中毒时主要损害是
A. 神经系统
B. 造血系统
C. 消化系统
D. 循环系统
E. 呼吸系统

正确答案：A。神经系统

解析：急性苯中毒（预防医学第三版P39-P40）主要表现为中枢神经系统症状（A对），轻者出现粘膜刺激症状，患者诉头痛、头晕、恶心、呕吐等，随后出现兴奋或酒醉状态，严重时发生昏迷、抽搐、血压下降、呼吸和循环衰竭。急性苯中毒是由于短时间在通风不良的作业场所，例如在密闭船舱、室内喷液时吸人大量苯蒸气而引起。